两种药物配伍之后效价降低的是
A. 头孢唑林钠与0.9%氯化钠注射液
B. 头孢曲松与复方氯化钠注射液
C. 胰岛素与0.90%氯化钠注射液
D. 青霉素与5%葡萄糖注射液
E. 维生素C与氯化钠注射液

正确答案：D。青霉素与5%葡萄糖注射液

解析：本题考查药物的配伍使用。两种药物配伍之后效价降低的是青霉素与5%葡萄糖注射液（D对）。青霉素含β-内酰胺环，酸性较强的葡萄糖注射液可促进青霉素裂解为无活性产物。头孢曲松钠不能与含钙注射液直接混合（B错）。头孢唑林钠（A错）、胰岛素（C错）、维生素C（E错）可以使用氯化钠做溶剂。